已知甲地老年人比例大于乙地，经普查甲地冠心病死亡率为5‰，乙地冠心病死亡率为4‰，若希望比较甲乙两地冠心病死亡率的高低，则
A. 计算标化率后再比较
B. 应做秩和检验
C. 可用两地的死亡率直接进行比较
D. 应做率的Z检验
E. 应做两个率比较的χ²检验

正确答案：A。计算标化率后再比较

解析：在比较甲乙两地冠心病死亡率的高低时，为消除其内部构成（如年龄、性别、工龄、病程长短、病情轻重等）对率的影响，应计算标化率后再比较（A对C错）。秩和检验（B错）、Z检验（D错）、χ²检验均只是一些检验方法，无法消除其内部构成产生的误差。